关于吸入气雾剂中药物吸收的叙述，正确的有
A. 吸入气雾剂具有速效作用
B. 吸入气雾剂可直接作用于支气管平滑肌
C. 口腔是吸入气雾剂的主要吸收部位
D. 药物的吸收速度与其脂溶性成正比
E. 药物的吸收速度与其分子大小成反比

正确答案：A、B、D、E。吸入气雾剂具有速效作用；吸入气雾剂可直接作用于支气管平滑肌；药物的吸收速度与其脂溶性成正比；药物的吸收速度与其分子大小成反比

解析：本题考查吸入气雾剂与喷雾剂的主要内容。关于吸入气雾剂中药物吸收的叙述，正确的有吸入气雾剂具有速效作用（A对）、吸入气雾剂可直接作用于支气管平滑肌（B对）、药物的吸收速度与其脂溶性成正比（D对）、药物的吸收速度与其分子大小成反比（E对）。气雾剂与喷雾剂特点：（1）具有速效和定位作用药物呈细小雾滴能够直达作用部位，局部浓度高，药物分布均匀，吸收快，奏效迅速。（2）制剂稳定性高药物装在密闭不透明的容器中，不易被微生物污染，且能避免与空气、水分和光线接触，提高了稳定性。（3）给药剂量准确副作用较小。（4）局部用药的刺激性小。吸入气雾剂和吸入喷雾剂给药时，药物以雾状吸入可直接作用于支气管平滑肌，适宜粒径的雾滴在肺泡部位有较好的分布和沉积，肺泡为药物的主要吸收部位。影响吸入气雾剂和吸入喷雾剂药物吸收的主要因素有：①药物的脂溶性及分子大小，吸入给药的吸收速度与药物的脂溶性成正比，与药物的分子大小成反比。②雾滴（粒）粒径大小，雾滴（粒）的大小影响其在呼吸道沉积的部位，吸入气雾剂雾滴（粒）的粒径应在10㎛以下，其中大多数应在5㎛以下。雾滴过粗，药物易沉着在口腔、咽部及呼吸器官的各部位；粒子过小，雾滴（粒）易到达肺泡部位，但沉积减少，多被呼出，吸收较少。